牙周脓肿与牙槽脓肿的鉴别要点不包括
A. 有无深牙周袋
B. 牙髓活力
C. 叩痛
D. X线表现
E. 牙龈炎症程度

正确答案：E。牙龈炎症程度

解析：本题考查牙周脓肿与牙槽脓肿的鉴别。牙龈炎症程度不能用来作为鉴别牙周脓肿和牙槽脓肿的要点，因为当牙槽脓肿向龈沟或牙周袋内排脓时，牙龈炎症程度（E错，为本题的正确答案）可和牙周脓肿时的牙龈炎症程度相当，不易鉴别。牙周脓肿与牙槽脓肿的鉴别要点有：有无深牙周袋（A对）、牙髓活力（B对）、叩痛（C对）、X线表现（D对）等。牙周脓肿有深牙周袋，牙槽脓肿无深牙周袋；牙周脓肿有牙髓活力，牙槽脓肿无牙髓活力；牙周脓肿叩痛相对较轻，牙槽脓肿叩痛很重；牙周脓肿X线片表现为牙槽嵴有破坏，可有骨下袋，牙槽脓肿X线片表现为根尖周可有骨质破坏，也可无。